具有清心安神功效的药物是
A. 玉竹
B. 龙眼肉
C. 人参
D. 柏子仁
E. 百合

正确答案：E。百合

解析：该题考查百合的功效，属记忆内容。百合味甘；性微寒；入肺、心、胃经；具有养阴润肺，清心安神的功效（E对）。玉竹为养阴药，没有安神的功能（A错）。龙眼肉具有养血安神的功效，没有清心安神的功能（B错）。人参为补气药，有安神益智的功效，没有清心安神的功能（C错）。柏子仁为养心安神药，没有清心安神的功能（D错）。